妊高症最基本的病理生理改变是
A. 全身小血管痉挛
B. 底蜕膜出血
C. 蜕膜萎缩
D. 滋养细胞增生
E. 绒毛退化

正确答案：A。全身小血管痉挛

解析：妊娠期高血压疾病的基本病理生理变化是全身小动脉痉挛，全身各系统各脏器灌流减少，对母儿造成危害，甚至导致母儿死亡。掌握“娠期高血压疾病”知识点。